下列不属于因果关系的是
A. 病因与疾病的关系
B. 治疗与其副作用的关系
C. 干预措施与其效果的关系
D. 人群与疾病的关系
E. 疾病及其并发症的关系

正确答案：D。人群与疾病的关系

解析：本题考查因果关系的概念。因果关系是一个事件（果）在时间上总是随着另一个事件（因）发生而发生的规律性关系，而且，假如因事件没有发生，果事件一定不会发生。人群与疾病的关系（D错，为本题正确答案）不符合因果关系。